临床试验机构实行
A. 备案管理
B. 年度管理
C. 审批管理
D. 认证管理

正确答案：A。备案管理

解析：本题考查药品研制政策与改革措施的主要内容。药品监督管理部门对药物临床试验机构实行备案管理（A对）。2019年《药品管理法》修订时，在药品研制环节规定多项制度，如药物临床试验机构备案管理制度等、药物临床试验默示许可制度、生物等效性试验备案制度、临床试验伦理审查制度、拓展性临床试验制度、优先审评制度、附条件审批制度、关联审评制度、药品上市许可转让制度。药品上市许可持有人应当汇总年度情况，包括企业年度药品不良反应监测体系运行情况、不良反应报告情况、风险识别与控制情况、上市后研究情况等信息，并于每年3月31日前向省（区、市 ）药品不良反应监测机构提交上一年度总结报告（B错）。国家药品监督管理局事权：国家药品监督管理局主管全国药品注册管理工作，负责建立药品注册管理工作体系和制度，制定药品注册管理规范，依法组织药品注册审评审批（C错）以及相关的监督管理工作。1998年，国务院机构改革，明确中药、西药领域的执业药师资格认证、注册和监管工作统一由国家药品监督管理局管理（D错）。